下列属于非概率抽样的方法是
A. 单纯随机抽样
B. 系统抽样
C. 机械抽样
D. 分层抽样
E. 定额抽样

正确答案：E。定额抽样